脊神经节细胞中枢突连于
A. 后正中沟
B. 前正中裂
C. 前外侧沟
D. 后外侧沟
E. 后中间沟

正确答案：D。后外侧沟

解析：脊神经前根连于脊髓前外侧沟（C错），后根连于脊髓后外侧沟（D对），其中后根在椎间孔处有椭圆形的膨大称脊神经节，与脊神经节细胞中枢突相连。